右侧结肠癌最多见的大体形态是
A. 浸润型
B. 溃疡型
C. 肿块型
D. 浸润溃疡型
E. 弥漫型

正确答案：C。肿块型

解析：结肠癌大体形态分为三型：隆起型、浸润型、溃疡型。右侧结肠癌最多见的大体形态是肿块型（C对）。浸润型（A错）多发生于左侧结肠。溃疡型（B错）是结肠癌常见类型，并不是右侧结肠癌最多见的大体形态。浸润溃疡型（D错）、弥漫型（E错）不属于结肠癌肉眼观分型。